根据《药品说明书和标签管理规定》，药品生产企业生产供上市销售的药品最小包装必须附有
A. 说明书
B. 标签
C. 执行标准
D. 注册商标
E. 注意事项

正确答案：A。说明书

解析：本题考查药品说明书与药品说明书的内容。根据《药品说明书和标签管理规定》，药品生产企业生产供上市销售的药品最小包装必须附有说明书（A对）。药品说明书与药品说明书的内容：药品说明书是指药品生产企业印制并提供的与药品使用有关的信息文字，包含药理学、毒理学、药效学、医学等药品安全性、有效性重要科学数据和结论，用以指导临床正确使用药品的技术资料。药品说明书是指导医师、药师和患者选择和使用的主要依据，具有科学上、医学上和法律上的意义，是判定相关纠纷及事故的重要依据。药品说明书由药品生产企业依照国家规定的格式要求，以及批准的内容编写，上市销售药品的最小包装中应附有药品说明书。药品说明书的具体格式、内容和书写要求由国家药品监督管理部门制定并发布。《药品管理法》第四十九条规定，标签或者说明书应当注明药品的通用名称、成分、规格、上市许可持有人及其地址、生产企业及其地址、批准文号、产品批号、生产日期、有效期、适应症或者功能主治、用法、用量、禁忌、不良反应和注意事项。标签、说明书中的文字应当清晰，生产日期、有效期等事项应当显著标注，容易辨识。